有一个分枝的花鹿茸习称
A. 二茬茸
B. 二杠
C. 莲花
D. 单门
E. 门庄

正确答案：B。二杠

解析：本题考查的是鹿茸的性状鉴别。有一个分枝的花鹿茸习称二杠（B对）。鹿茸【性状鉴别】花鹿茸①锯茸：呈圆柱状分枝，具一个分枝者习称“二杠”，主枝习称“大挺”，长17～20cm，锯口直径4～5cm，离锯口约1cm处分出侧枝，习称“门庄（E错）”，长9～15cm，枝顶钝圆，较主枝（大挺）略细。外皮红棕色或棕色，多光润，表面密生红黄色或棕黄色细茸毛，上端毛密，下端较疏，分岔间具1条灰黑色筋脉，皮茸紧贴。锯口面黄白色，中部密布细孔，外围无骨质。体轻。气微腥，味微咸。具二个分枝者习称“三岔”，主枝长23～33cm，直径较二杠细，略呈弓形而微扁，枝端略尖，下部有纵棱筋及突起小疙瘩。皮红黄色，茸毛较稀而粗。锯口外围略显骨化。体轻。气微腥，味微咸。二茬茸（A错）（再生茸）：和头茬茸近似，但主枝长而不圆或下粗上细，下部有纵棱筋，皮灰黄色，茸毛较粗糙，锯口外围多已骨化。体较重，无腥气。马鹿茸较花鹿茸粗大，分枝较多，侧枝1个者习称“单门（D错）”，2个者习称“莲花（C错）”，3个者习称“三岔”，4个者习称“四岔”或更多。其中以莲花、三岔为主。